二氧化钛在明胶空心胶囊中作
A. 增塑剂
B. 增稠剂
C. 增光剂
D. 遮光剂
E. 防腐剂

正确答案：D。遮光剂

解析：本题考查的是明胶空心胶囊的囊材组成。二氧化钛在明胶空心胶囊中作遮光剂（D对）。明胶空心胶囊的囊材组成：明胶是空胶囊剂的主要囊材。另外，还要加入适当的辅料，以满足制备和不同产品的要求，保证囊壳的质量要求。常用的有：①增塑剂（A错），如甘油、山梨醇、羧甲纤维素钠等，可增加囊壳的韧性与可塑性。②增稠剂（B错），如琼脂可增加胶液的胶冻力。③遮光剂，如二氧化钛，可防止光对药物氧化的催化，增加光敏性药物的稳定性。④着色剂，如柠檬黄、胭脂红等可增加美观，便于识别。⑤防腐剂（E错），常用对羟基苯甲酸酯类，如羟苯甲酯、羟苯乙酯、羟苯丙酯与羟苯丁酯等，可防止胶液在制备和贮存过程中发生霉变。⑥增光剂（C错），如十二烷基磺酸钠，可增加囊壳的光泽。⑦芳香矫味剂，如乙基香草醛等，可调整胶囊剂的口感等。